影响牙周炎患牙松动度的主要因素是
A. 牙根的数目
B. 牙根的形态
C. 牙槽骨吸收的程度
D. 邻牙存留情况
E. （牙合）创伤

正确答案：C。牙槽骨吸收的程度

解析：一般而言，探诊深度与牙槽骨吸收的程度是相应的，如牙周袋愈深，骨吸收的量愈多，牙周支持组织的破坏也愈严重，牙齿就难以保留。掌握“慢性牙周炎的病因，表现诊断及预后”知识点。